心肌细胞中传导速度最高的是
A. 心室肌
B. 心房肌
C. 窦房结
D. 房室交界
E. 浦肯野纤维

正确答案：E。浦肯野纤维